隔缘肉柱位于
A. 前乳头肌根部至三尖瓣环之间
B. 前乳头肌根部至三尖瓣前瓣根部之间
C. 后乳头肌根部至室间隔下部之间
D. 前乳头肌根部至室间隔下部之间
E. 无

正确答案：D。前乳头肌根部至室间隔下部之间

解析：前乳头肌根部至室间隔下部之间（D对）为隔缘肉柱。